引起温室效应的主要污染物是
A. 氯氟烃
B. 烟尘
C. CO₂
D. SO₂、颗粒物
E. SO₂、NOₓ

正确答案：C。CO₂

解析：本题考查引起温室效应的主要污染物。大气层中某些气体能吸收地表发射的热辐射，使大气增温，称为温室效应。这些气体统称为温室气体，主要包括CO₂、甲烷（CH₄）、氧化亚氮（N₂O）和氯氟烃（CFC）等。其中CO₂（C对ABDE错）是引起温室效应的主要污染物。